残胃癌发生在胃良性病变施行胃大部切除术后至少
A. 1年
B. 2年
C. 3年
D. 4年
E. 5年

正确答案：E。5年

解析：残胃癌发生在胃良性病变施行胃大部切除术后至少5年（E对）。